具有温煦推动兴奋和宣散作用的物质是
A. 肾阴
B. 肾阳
C. 肾精
D. 肾气
E. 肾血

正确答案：B。肾阳

解析：肾阳为脏腑阳气之本，可推动和激发脏腑的各种功能，温煦全身脏腑形体官窍。肾阳充盛，脏腑形体官窍得以温煦，各种功能旺盛，精神振奋（B对）。若肾阳虚衰，推动、温煦等作用减退，则脏腑功能减退，精神不振，发为虚寒性病证。肾阴为脏腑阴液之本，可宁静和抑制脏腑的各种功能，滋润全身脏腑形体官窍。肾阴充足，脏腑形体官窍得以滋润，其功能健旺而又不至于过亢，精神内守。若肾阴不足，抑制、宁静、滋润等作用减退，则致脏腑功能虚性亢奋，精神虚性躁动，发为虚热性病证（A错）。肾精，即肾藏之精，来源于先天，充养于后天，是肾脏生理活动的物质基础（C错）。肾气，即肾精所化之气，是肾脏生理活动的物质基础及其动力来源。肾气分为肾阴、肾阳二部分：肾阴具有宁静、滋润、和濡养作用，肾阳具有推动、温煦、振奋作用。肾阴与肾阳对立统一，相反相成，平衡协调，则肾气冲和（D错）。人体血液的生成，一方面是后天脾胃运化的水谷精微上输心肺而化赤为血；另一方面是肾精生髓，髓充于骨，骨中精髓为化生血液之源。肾精充足而精髓盈满，则血液生化有源（E错）。